男性，24岁，右侧可复性腹股沟斜疝，最佳手术治疗方法应选择
A. 单纯疝囊高位结扎
B. 佛格逊法修补
C. 巴西尼法修补
D. 麦克凡法修补
E. 疝成形术

正确答案：C。巴西尼法修补

解析：巴西尼法：是修补腹股沟管后壁的方法，适用于成人斜疝和腹壁一般性薄弱者（C对）。单纯疝囊高位结扎（A错）主要用于婴幼儿。佛格逊法修补（B错）适用于腹股沟管后壁发育尚健全的儿童和青年人较小的斜疝。麦克凡法修补（D错）多用于腹壁重度薄弱的较大斜疝和复发性疝。疝成形术（E错）适用于巨型疝或复发性疝、腹股沟管后壁严重缺损等无法利用局部组织进行修补者。